贝母瓜蒌散主治
A. 湿痰犯肺咳嗽
B. 痰热内结咳嗽
C. 肺燥有痰咳嗽
D. 寒痰内蕴咳嗽
E. 风邪犯肺咳嗽

正确答案：C。肺燥有痰咳嗽

解析：贝母瓜蒌散的功用为润肺清热，理气化痰，主治燥痰咳嗽。咳嗽痰少，咯痰不爽，涩而难出，咽喉干燥，苔白而干（C对）。二陈汤主治湿痰犯肺咳嗽（A错）。清气化痰丸主治痰热内结咳嗽（B错）。苓甘五味姜辛汤主治寒痰内蕴咳嗽（D错）。止嗽散主治风邪犯肺咳嗽（E错）。